甲状腺手术后最危急的并发症
A. 呼吸困难
B. 创口渗血
C. 手足抽搐
D. 声音嘶哑
E. 甲状腺危象

正确答案：A。呼吸困难

解析：呼吸困难和窒息（A对）是甲状腺手术术后最危急的并发症，多发生在术后48小时内，如不及时发现、处理，则可危及病人生命。术后如出现呼吸困难，颈部肿胀，必须立刻行床边抢救。如症状无改善，则应立即行气管插管。手足抽搐（C错）多因甲状旁腺功能减退引起，保守治疗无效可行甲状旁腺移植，不是术后最危急的并发症。声音嘶哑（D错）为喉返神经损伤症状，可采用保守治疗处理，不是术后最危急的并发症。甲状腺危象（E错）为甲亢术后的严重并发症，多因术前准备不够、甲亢症状未能很好的控制及手术应激有关。创口渗血（B错）不属于术后主要并发症，但应密切观察有无颈部肿胀及呼吸困难。